女，28岁。平时月经规则，现停经60天，阴道流血10天。妇科检查子宫如妊娠3个月大，软，无压痛，双侧附件区均扪及5cm囊性包块，壁薄，活动好，无压痛。血HCG增高明显。合适的治疗是
A. 负压吸宫术
B. 子宫切除术
C. 化学药物治疗
D. 放射治疗
E. 性激素治疗

正确答案：A。负压吸宫术

解析：患者为年轻女性，平时月经规则，现停经60天（疑为早孕），阴道流血10天（葡萄胎患者一般在停经8～12周左右开始不规则阴道流血，量多少不定）。妇科检查子宫如妊娠3个月大，软（因葡萄胎迅速增长及宫腔内出血，约半数以上患者的子宫大于停经月份，质地变软），无压痛，双侧附件区均扪及5cm囊性包块，壁薄，活动好，无压痛（大量hCG刺激卵巢卵泡内膜细胞发生黄素化形成卵巢黄素化囊肿。常为双侧，大小不等，活动度好，囊壁薄）。血hCG增高明显（葡萄胎患者hCG水平异常升高），最可能的诊断是葡萄胎。一经确诊，应及时清宫，一般选用负压吸宫术（A对）。子宫切除术（P338）（B错）不作为葡萄胎的常规处理，只用于年龄接近绝经、无生育要求者，该患者处于生育年龄，不选用此治疗。化学药物治疗（C错）和放射治疗（D错）用于恶性肿瘤的治疗，而葡萄胎属良性病变，不采用以上两种治疗。性激素治疗（E错）用于性激素缺乏或分泌不足、闭经的患者，不用于葡萄胎的治疗。